含交感神经节后纤维的神经是
A. 内脏大神经
B. 内脏小神经
C. 腰内脏神经
D. 心上、中、下神经
E. 盆内脏神经

正确答案：D。心上、中、下神经

解析：内脏大神经（A错）、内脏小神经（B错）、腰内脏神经（C错）、盆内脏神经（E错）均由交感神经节前纤维构成。心上、中、下神经（D对）由颈交感干神经节的节后纤维构成。